50岁妇女，白带带血1月，复查，宫颈中度糜烂，易出血，子宫大小质地正常，附件正常，阴道镜下多点活检报告为CINⅢ。其处理下述哪项恰当
A. 子宫全切术
B. 子宫根治术
C. 诊断性刮宫
D. 定期随访
E. 激光治疗

正确答案：A。子宫全切术

解析：患者为中老年女性，出现血性白带，妇检：宫颈中度糜烂，易出血，阴道镜下多点活检报告为CINⅢ，诊断为CINⅢ。患者年龄较大，无生育要求，在题目所给的答案之中，最恰当的治疗为子宫全切术（A对），但根据八年制第2版妇产科学（P318）观点，不宜将全子宫切除术作为CINⅡ、CINⅢ的首要或初始治疗方法。子宫根治术（B错）（子宫切除及淋巴结清扫）是子宫颈癌的治疗方法。诊断性刮宫（C错）是子宫内膜癌的确诊方法。定期随访（P303）（D错）、激光治疗（P303）（E错）适用于CINⅠ。